小儿前囟闭合的时间约在
A. 3～4个月
B. 4～6个月
C. 6～12个月
D. 1～1.5岁
E. 2岁

正确答案：E。2岁

解析：小儿前囟出生时约为1～2cm，以后随颅骨生长而增大，6月龄左右逐渐骨化而变小，最迟于2岁闭合。一般在两岁之前（D对）。